当下颌骨被固定时，颏舌骨肌牵引舌骨可
A. 向前上
B. 向前下
C. 向前左
D. 向前右
E. 无变化

正确答案：A。向前上

解析：颏舌骨肌：当下颌骨被固定时，颏舌骨肌牵引舌骨向前上；舌骨被固定时，可牵引下颌骨向下。掌握“咀嚼肌、颈部肌及口颌系统肌链”知识点。